二期梅毒的诊断标准中，描述错误的一项是
A. 病程两年以上
B. 有不洁性交史或下疳史
C. 多种皮疹伴全身淋巴结肿大
D. 检查到梅毒螺旋体
E. 梅毒血清试验阳性

正确答案：A。病程两年以上

解析：本题考查二期梅毒的诊断标准。二期梅毒的诊断标准中，描述错误的一项是病程两年以上（A错，为本题的正确答案）。二期梅毒病程少于两年。后天梅毒约95%以上通过性接触传染，二期梅毒常发生于硬下疳消退后3-4周（B对）。二期梅毒有全身淋巴结肿大的症状且伴有斑疹性梅毒疹和丘疹性梅毒疹等皮肤损害（C对）。二期梅毒的皮肤和分泌物中含有大量的梅毒螺旋体，故可检查到梅毒螺旋体（D对）。梅毒螺旋体由淋巴系统可进入血液循环形成菌血症，故梅毒血清试验阳性（E对）。